女，38岁。接触性出血1月余，白带有恶臭，妇科检查，宫颈Ⅱ°糜烂，前唇有5cm×3cm的质地脆赘生物，易出血。子宫正常大，三合诊（-）。最恰当的治疗方法为
A. 宫颈锥切术
B. 放射治疗
C. 全子宫切除术
D. 次广泛性子宫切除术加盆腔淋巴结切除术
E. 广泛性子宫切除术加盆腔淋巴结切除术

正确答案：E。广泛性子宫切除术加盆腔淋巴结切除术

解析：该患者有接触性出血、白带伴恶臭（宫颈癌常表现为接触性出血，晚期患者因癌组织坏死伴感染，可有大量米泔样或脓性恶臭白带），妇检：宫颈Ⅱ度糜烂，前唇有5cm×3cm（＞4cm）的质地脆赘生物，易出血（外生型子宫颈癌可见息肉状、菜花状赘生物，常伴感染，质脆易出血）。子宫正常大，三合诊阴性（临床癌灶局限于子宫颈，未侵及子宫和宫旁组织），最可能的诊断是子宫颈癌ⅠB2期。根据子宫颈癌手术治疗原则，对于子宫颈癌ⅠB2期，应行广泛性子宫切除术加盆腔淋巴结切除术（E对D错）。宫颈锥切术（P303）（A错）适用于阴道镜检查不满意的CINⅡ和所有的CINⅢ患者。放射治疗（P308）（B错）适用于部分ⅠB2期不宜手术治疗者。全子宫切除术（P308）（C错）适用于ⅠA1期子宫颈癌无淋巴脉管间隙浸润的患者。